一患者戴用全口义齿1周，主诉咬合疼痛，定位不明确。检查：粘膜未见红肿或溃疡部位，基托边缘伸展合适，做正中（牙合）咬合时，上颌义齿有明显扭转，问题是
A. 基托不密合
B. 基托翘动
C. 侧方（牙合）早接触
D. 前伸（牙合）干扰
E. 正中关系有误

正确答案：E。正中关系有误

解析：本题考查全口义齿颌位关系及上（牙合）架。患者在做正中咬合时，上颌义齿有明显扭转，所以正中（牙合）有问题（E错，为本题正确答案），当患者做侧方咬合时如出现明显扭转、动度则说明侧方（牙合）有（牙合）干扰。这也是在临床上选磨的步骤，先选磨正中（牙合）的早接触，再选磨侧方（牙合）的（牙合）干扰，最后选择前伸（牙合）的（牙合）干扰的选磨。